对某化学物进行哺乳动物致癌试验。试验开始时每组有大鼠120只；12个月时高剂量组有1只大鼠发生肿瘤，有80只大鼠存活；18个月时高剂量组共有3只大鼠发生肿瘤，有60只大鼠存活；试验结束时高剂量组共有12只大鼠发生肿瘤，尚有48只大鼠存活。根据上述试验结果，高剂量组的肿瘤发生率（%）为
A. 0.1
B. 0.15
C. 0.2
D. 0.25
E. 0.3

正确答案：B。0.15